成年人骨骼和牙齿中的含钙量占人体总钙量的比例为
A. 19%
B. 39%
C. 59%
D. 79%
E. 99%

正确答案：E。99%